男，56岁。2年来表现为烦渴多食、多饮、多尿，体重下降，疲倦无力，注意力不集中，失眠，情绪低落，主动性差，反应迟钝。1周前出现兴奋不安，言语紊乱而住院。该患者最可能的诊断是
A. 肾上腺皮质功能减退所致精神障碍
B. 甲状腺功能减退所精神障碍
C. 糖尿病所致精神障碍
D. 甲状腺功能亢进所致精神障碍
E. 肾上腺皮质功能亢进所致精神障碍

正确答案：C。糖尿病所致精神障碍

解析：患者为中年男性，有烦渴多食、多饮、多尿，体重下降（三多一少），伴中枢神经系统症状，考虑患者为糖尿病并神经系统并发症。1周前出现兴奋不安，言语紊乱（意识障碍），患者最可能的诊断是糖尿病所致精神障碍（C对）。